依照《药品经营质量管理规范实施细则》，药品储存时，对近效期药品，填报效期报表的周期是
A. 日
B. 周
C. 月
D. 季
E. 年

正确答案：C。月